诸禁鼓栗，如丧神守，皆属于
A. 风
B. 火
C. 燥
D. 心
E. 热

正确答案：B。火

解析：《内经》曰：“诸禁鼓栗，如丧神守，皆属于火（B对）。诸风（A错）掉眩，皆属于肝。”刘完素补充：“诸涩枯涸，干劲皴揭，皆属于燥（C错）。诸痛痒疮，皆属于心（D错）。诸病有声，鼓之如鼓，皆属于热（E错）。”